治疗子宫内膜异位症寒凝血瘀证，应首选
A. 膈下逐瘀汤
B. 少腹逐瘀汤
C. 血府逐瘀汤
D. 桃红四物汤
E. 艾附暖宫丸

正确答案：B。少腹逐瘀汤

解析：治疗子宫内膜异位症的寒凝血瘀证应温经散寒，化瘀止痛，首选少腹逐瘀汤（B对）。膈下逐瘀汤用于治疗子宫内膜异位症气滞血瘀证（A错）。血府逐瘀汤活血化瘀，行气止痛，主治胸中瘀血证（C错）。桃红四物汤主治血虚兼血瘀证（D错）。艾附暖宫丸治疗血虚气滞、下焦虚寒所致的月经不调，痛经（E错）。